结构中含有两个手性碳原子，有三个异构体的药物是
A. 左氧氟沙星
B. 盐酸乙胺丁醇
C. 利巴韦林
D. 齐多夫定
E. 氯霉素

正确答案：B。盐酸乙胺丁醇

解析：本题考查乙胺丁醇。盐酸乙胺丁醇（B对）含两个手性碳，构型相同，故只有三个旋光异构体。左氧氟沙星（A错）含一个手性碳。利巴韦林（C错）含四个手性碳。齐多夫定（D错）含三个手性碳。氯霉素（E错）含两个手性碳，有四个异构体。